用于确证哺乳动物致癌物试验是
A. 构效关系分析
B. 致突变试验，恶性转化试验
C. 哺乳动物短期致癌试验
D. 哺乳动物长期致癌试验
E. 流行病学调查

正确答案：D。哺乳动物长期致癌试验